在感染过程中，最常见的表现形式是
A. 潜伏性感染
B. 隐性感染
C. 显性感染
D. 病原携带状态
E. 病原体被清除

正确答案：B。隐性感染

解析：病原体被清除、隐性感染、显性感染、病原携带状态、潜伏性感染都是传染病感染过程的表现形式。除病原体被清除外，另外四种表现形式在不同传染病中各有侧重，一般来说，隐形感染最常见（B对），病原携带状态次之，显性感染所占比重最低，但一旦出现，则容易识别。